患者，女，25岁，左上2牙冠缺损1/3，咬合关系正常，牙髓未暴露，最佳修复设计是
A. 烤瓷熔附金属全冠修复
B. 嵌体修复
C. 3/4冠修复
D. 金属塑料联合全冠修复
E. 根管治疗后烤瓷桩冠修复

正确答案：A。烤瓷熔附金属全冠修复

解析：题干告知患者为成年女性，左上2牙冠缺损1/3，咬合关系正常且未露髓。掌握“烤瓷熔附金属冠”知识点。